引起中药发生质变的内因之一是
A. 吸水性
B. 湿度
C. 水分
D. 高温
E. 日光

正确答案：C。水分

解析：本题考查的是自身因素对中药质量变异的影响。引起中药发生质变的内因之一是水分（C对）。自身因素对中药质量变异的影响：1.水分；2.淀粉；3.黏液质；4.油脂；5.挥发油；6.色素；7.鞣质；8.无机化合物；9.树脂。湿度（B错）、温度（D错）与日光（E错）为外界因素对中药质量变异的影响。药材、饮片、中成药在贮藏过程中，由于受到外界诸多因素的影响，其质量也会不断发生变化。这些外界因素包括：1.温度；2.湿度；3.日光；4.空气；5.霉菌；6.虫害；7.包装容器；8.贮存时间。